下列激素属于类固醇激素的是
A. 甲状腺激素
B. 肾上腺皮质激素
C. 抗利尿激素
D. 肾上腺素
E. 胰高血糖素

正确答案：B。肾上腺皮质激素

解析：肾上腺皮质激素包括皮质醇和醛固酮，都属于类固醇类激素（B对）。甲状腺激素、肾上腺素属于胺类激素（AD错）。抗利尿激素、胰高血糖素属于肽类激素（CE错）。